根据中药的配伍禁忌理论（十八反药歌），在同一处方中不得出现的生药组合是
A. 半夏和川乌
B. 大戟和甘草
C. 人参和藜芦
D. 沙参和藜芦
E. 党参和藜芦

正确答案：A、B、C、D。半夏和川乌；大戟和甘草；人参和藜芦；沙参和藜芦

解析：本题考查的是饮片的配伍禁忌。根据中药的配伍禁忌理论（十八反药歌），在同一处方中不得出现的生药组合是半夏和川乌（A对）、大戟和甘草（B对）、人参和藜芦（C对）、沙参和藜芦（D对）。十八反列述了三组相反药，分别是：甘草反甘遂、京大戟、海藻、芫花；乌头（川乌、附子、草乌）反半夏、瓜蒌（全瓜蒌、瓜蒌皮、瓜蒌仁、天花粉）、贝母（川贝、浙贝）、白蔹、白及；藜芦反人参、南沙参、丹参、玄参、苦参、细辛、芍药（赤芍、白芍）。